患者，男，70岁，因泌尿道慢性感染就诊，经检测属于革兰阴性菌感染。其治疗药品处方组分中包括：主药、微晶纤维素(空白丸核）、乳糖、枸橼酸、EudragitNE30D、EudragitL3OD-55、滑石粉、PEG6000、十二烷基硫酸钠。该药品处方组分中的“主药”应是
A. 红霉素
B. 青霉素
C. 阿奇霉素
D. 氧氟沙星
E. 氟康唑

正确答案：D。氧氟沙星

解析：本题考查氧氟沙星缓释胶囊。该药品处方组分中的“主药”应是氧氟沙星（D对）。氧氟沙星缓释胶囊中氧氟沙星为主药；丸芯中枸橼酸为pH缓冲剂和渗透压调节剂；微晶纤维素和乳糖为稀释剂；包衣液处方中PEG6000为增塑剂；滑石粉为抗黏剂；Eudragit NE30D和Eudragit L30D-55为主要缓释包衣材；水为溶剂，十二烷基硫酸钠为稳定剂。